急性心肌梗死最常见的心律失常是
A. 房性早搏或心房纤颤
B. 室性早搏或室性心动过速
C. 房室传导阻滞
D. 预激综合征
E. 右束支传导阻滞

正确答案：B。室性早搏或室性心动过速

解析：急性心肌梗死心律失常见于75%～95%的患者，以发病24小时内最常见，可伴心悸、乏力、头晕、晕厥等症状，其中以室性心律失常居多，可出现室性早搏、室性心动过速（B对）、室性颤动或加速性心室自主心律。室上性心律失常则发生较少，多发生在心力衰竭中，故房性早搏或心房纤颤（A错）、房室传导阻滞（C错）、预激综合征（D错）、右束支传导阻滞（E错）均不常见。